健康教育计划实施过程中的监测内容不包括
A. 工作进程
B. 活动内容和开展情况
C. 人群知信行和相关危险因素
D. 经费开支情况
E. 行为改变情况

正确答案：E。行为改变情况